金葡菌肺炎患儿突然出现呼吸急促，首先应考虑
A. 高热
B. 酸中毒
C. 脓气胸
D. 炎症加重
E. 心力衰竭

正确答案：C。脓气胸

解析：金黄色葡萄球菌肺炎病理改变以肺组织广泛出血性坏死和多发性小脓肿形成为特点，因此金葡菌肺炎很易形成肺脓肿、气胸等。结合患儿儿突然出现呼吸急促的表现，可知该患儿并发了脓气胸（C对）。